肺癌最常见的转移部位是
A. 肠
B. 胃
C. 肾
D. 脾
E. 脑

正确答案：E。脑

解析：肺癌经血道转移至全身各器官，最常转移至脑（E对），也可转移至肾（C错）、肝等，极少转移至肠（A错）、胃（B错）、脾（D错）。